关于单硝酸异山梨酯性质的说法，正确的是
A. 受热或受撞击不易爆炸
B. 比硝酸异山梨酯的半衰期短
C. 比硝酸异山梨酯的活性强
D. 是硝酸异山梨酯的体内活性代谢产物
E. 比硝酸异山梨酯更易进入中枢系统

正确答案：D。是硝酸异山梨酯的体内活性代谢产物

解析：本题考查单硝酸异山梨酯。硝酸异山梨酯在肝脏内代谢生成单硝酸异山梨酯（D对），临床主要用于预防缺血发生。单硝酸异山梨酯不稳定，受热或受到撞击易发生爆炸（A错）。硝酸山梨酯与单硝酸异山梨酯的半衰期都在5h左右（B错）。硝酸异山梨酯与单硝酸异山梨酯均具有强的药理活性（C错）。硝酸异山梨酯比单硝酸异山梨酯脂溶性强，更易进入中枢系统（E错）。